既益气养阴，又固精止带的药是
A. 肉苁蓉
B. 山药
C. 何首乌
D. 石斛
E. 麦冬

正确答案：B。山药

解析：本题考查的是山药的功效。既益气养阴，又固精止带的药是山药（B对）。山药：【功效】益气养阴，补脾肺肾，固精止带。肉苁蓉（A错）：【功效】补肾阳，益精血，润肠通便。何首乌（C错）：【功效】补益精血，解毒，截疟，润肠通便。石斛（D错）：【功效】养胃生津，滋阴除热，明目，强腰。麦冬（E错）：【功效】润肺养阴，益胃生津，清心除烦，润肠通便。